颅内肿瘤若表现为精神症状，常考虑的肿瘤部位为
A. 小脑
B. 顶叶
C. 额叶
D. 枕叶
E. 岛叶

正确答案：C。额叶

解析：（P66）颅内肿瘤可损害正常脑组织、压迫邻近脑实质或脑血管，造成颅内压增高，出现局灶性神经系统症状、癫痫发作或精神症状。大部分额叶肿瘤患者会出现精神症状，而且精神症状较其他部位肿瘤多见（C对）。小脑肿瘤主要引起脑积水，表现为共济失调、颅内高压症状及颅神经麻痹，较少有精神症状（A错）。顶叶肿瘤以感觉障碍为主，较少引起精神症状（B错）。枕叶肿瘤通常引起视幻觉（D错）。岛叶肿瘤主要表现为内脏反应，较少有精神症状（E错）。